主动脉弓
A. 续于升主动脉，呈弓形弯向左后方
B. 凸侧有4大分支
C. 自左心室起，呈弓形弯向左后方
D. 凹侧有3大分支
E. 发出左右冠状动脉

正确答案：A。续于升主动脉，呈弓形弯向左后方

解析：主动脉弓续于升主动脉（C错），呈弓形弯向左后方（A对）。从凸侧（D错）有发出头臂干、左颈总动脉和左锁骨下动脉共3（B错）大分支，升主动脉发出左、右冠状动脉（E错）。